关于硬膜外隙的说法，错误的是
A. 有脊神经根通过
B. 呈负压状态
C. 与颅内相通
D. 内含静脉丛
E. 与脑脊液循环无关

正确答案：C。与颅内相通

解析：硬脊膜与椎管内面的骨膜之间的间隙称硬膜外隙，内含疏松结缔组织、脂肪、淋巴管、静脉丛（D对）和脊神经根（A对）等。此间隙呈负压状态（B对），不与颅内相通（C错，为本题正确答案）。脑脊液循环主要经过脑室系统、蛛网膜下隙，因而硬膜外隙与脑脊液循环无关（E对）。